又称为“蛤蟆肿”的是
A. 黏液囊肿
B. 舌下腺囊肿
C. 甲状舌管囊肿
D. 皮样囊肿
E. 表皮样囊肿

正确答案：B。舌下腺囊肿

解析：舌下囊肿又称蛤蟆肿，是一种特指发生于口底的黏液囊肿，舌下囊肿病变中的黏液成分多来自舌下腺，但有些囊肿也可发生于下颌下腺的导管。掌握“舌下腺及唾液腺黏液囊肿”知识点。